甲状旁腺的描述，错误的是
A. 棕黄色，呈扁椭圆形
B. 似黄豆大小
C. 当其功能亢进时易发生骨折
D. 通常分为上、下两对
E. 多位于甲状腺实质内

正确答案：E。多位于甲状腺实质内

解析：甲状旁腺似黄豆大小（B对），棕黄色、呈扁椭圆形（A对）。位于甲状腺左、右侧叶的后面，通常分为上、下两对（D对）。在甲状旁腺激素过多时，骨骼中的钙质不断地进入血液，骨骼中钙含量逐渐减少，骨质变得疏松，在轻微外力撞击下就会引起骨折，称为病理性骨折（C对）。甲状旁腺多位于甲状腺的左，右侧叶后面，少部分可位于甲状腺实质内（E错，为本题正确答案）。